主要不是经输血传播的病毒是
A. HBV
B. AIDS病毒
C. 乙型脑炎病毒
D. 丙型肝炎病毒
E. 巨细胞病毒

正确答案：C。乙型脑炎病毒

解析：垂直传播指通过胎盘或产道，病毒直接由亲代传播给子代的方式。常见导致垂直传播的病毒有风疹病毒、乙型肝炎病毒（HBV）、AIDS病毒（HIV）、丙型肝炎病毒（HCV）、巨细胞病毒（CMV）等十余种，可引起死胎、流产、早产或先天性感染或先天性畸形等。流行性乙型脑炎（简称乙脑）的储存宿主和主要传染源为猪、马、牛、羊、鸭、鹅等畜、禽，呈携带病毒状态，多不致动物病，而可通过库蚊、伊蚊及按蚊等吸血蚊种叮咬将病毒传播给人并导致严重的致死性脑炎疾患。携带乙脑病毒的越冬雌蚊，可经卵、幼虫垂直传播给子代蚊，故雌蚊也作为乙脑病毒的储存宿主。掌握“病毒传播方式、感染类型、致病机制及免疫”知识点。